下列具有致畸胎作用的抗癫痫药物是
A. 苯妥英钠
B. 苯巴比妥
C. 卡马西平
D. 苯二氮类
E. 乙琥胺

正确答案：A。苯妥英钠

解析：本题考查具有致畸胎作用的抗癫痫药物。具有致畸胎作用的抗癫痫药物是苯妥英钠（A对）。苯巴比妥（B错）的不良反应为用药初期嗜睡、精神萎靡等，长期使用易产生耐受性。卡马西平（C错）的常见不良反应有眩晕、视力模糊、恶心呕吐、共济失调、手指震颤、水钠潴留等。苯二氮类（D错）毒性较小，最常见的不良反应是嗜睡、头晕、乏力和记忆力下降。乙琥胺（E错）常见的副作用为胃肠道反应，其次为为中枢神经系统症状，易引起精神行为失常，表现为焦虑、抑郁、短暂的意识丧失、攻击行为、多动、精神不集中和幻听等。